中年以上男性持续或间断咯血或少暈咯血，最大的可能是
A. 肺炎
B. 肺脓肿
C. 肺气肿
D. 肺癌
E. 肺梗死

正确答案：D。肺癌

解析：肺癌常见于中老年男性，其临床表现与肿瘤的大小、类型、发展阶段、所在部位、有无并发症或转移有密切关系。痰血或咯血多见于中央型肺癌，男性多于女性。肿瘤向管腔内生长者可有间歇或持续性痰中带血，如果表面糜烂严重侵蚀大血管，则可引起大咯血。对于本题干中中年以上男性持续或间断咯血或少暈咯血，排除基础肺部疾病，最大可能是肺癌（D对）。肺炎（A错）多有上呼吸道感染的前驱症状，主要表现为发热、胸痛、咳吐铁锈色痰、肺部听诊湿啰音、呼吸困难。肺脓肿（B错）临床特征为高热、咳嗽、咳大量脓臭痰。肺气肿（C错）主要症状为慢性咳嗽、咳痰、气短或呼吸困难、喘息、胸闷。肺梗死（E错）主要表现为呼吸困难、胸痛、咯血。